14岁男孩，因腹痛来院就诊，查体：双下肢出现对称性成片状小出血点，尿常规发现血尿+++，该患者最可能的诊断是
A. 肾血管畸形
B. 过敏性紫癜肾炎
C. 肾绞痛
D. 急性肾盂，肾炎
E. 肾下垂

正确答案：B。过敏性紫癜肾炎

解析：过敏性紫癜多急性起病，首发症状以皮肤紫癜为主，少数以腹痛、关节炎或肾脏症状首先出现。临床主要表现为：皮肤紫癜、胃肠道症状、关节症状、肾脏症状和出血倾向。该患儿双下肢对称性出血点、腹痛，均为过敏性紫癜的表现，同时伴有血尿，符合过敏性紫癜肾炎的临床表现（B对）。